治未病的内涵为
A. 未病先防
B. 既病防变
C. 二者均是
D. 二者均非

正确答案：C。二者均是

解析：本题考查的是治未病。治未病的内涵为未病先防与既病防变（C对）。治未病，是指采取相应的措施，防止疾病的发生发展，包括未病先防、既病防变、愈后防复三方面。